对于利培酮性质的说法，下列错误的是
A. 非经典型抗精神病药
B. 锥体外系副作用小
C. 口服吸收完全
D. 代谢产物帕利哌酮仍具有药理活性
E. 属于三环类抗精神病药

正确答案：E。属于三环类抗精神病药

解析：本题考查利培酮。对于利培酮性质的说法，下列错误的是属于三环类抗精神病药（E错，为本题正确答案）。利培酮是非经典抗精神病药物（A对），分子中不具有三环的结构。利培酮与经典抗精神病药物相比，没有或较少有锥体外系副作用（B对）。利培酮口服吸收迅速、完全（C对），其吸收不受食物影响，用药1小时后即达血药峰浓度，消除半衰期约为3小时，大多数患者在1天内达到稳态。在体内部分代谢为9-羟利培酮，具有药理活性（E对），其消除半衰期为24小时。本品大部分从肾脏排泄。老年患者和肾功能不全患者清除速度较慢。